急性小肠扭转易发生
A. 机械性肠梗阻
B. 单纯性肠梗阻
C. 麻痹性肠梗阻
D. 痉挛性肠梗阻
E. 绞窄性肠梗阻

正确答案：E。绞窄性肠梗阻

解析：绞窄性肠梗阻指有肠壁血运障碍的肠梗阻。急性小肠扭转为一段肠管甚至全部小肠及其系膜沿系膜轴扭转360°～720°，因此，既有肠管的梗阻，又有肠系膜血液循环障碍，易发生绞窄性肠梗阻（E对）。机械性肠梗阻（A错）为肿瘤压迫、蛔虫梗阻等机械性因素引起肠腔狭小或不通，使肠内容物不能通过所致的肠梗阻，无血运障碍。单纯性肠梗阻（B错）仅有肠内容物通过受阻，而无肠管血运障碍的肠梗阻。麻痹性肠梗阻（C错）多发生在腹腔手术后、腹部创伤等的病人，由于严重的神经、体液及代谢改变使肠壁肌运动紊乱所致。痉挛性肠梗阻（D错）多见于急性肠炎、肠道功能紊乱或慢性铅中毒病人。